氯霉素可以导致新生儿
A. 腹泻
B. 核黄疸
C. 灰婴综合征
D. 肺炎
E. 呼吸窘迫综合症

正确答案：C。灰婴综合征

解析：本题考查氯霉素的不良反应。氯霉素可以导致新生儿出现灰婴综合征（C对）。氯霉素可透过胎盘屏障，对早产儿和足月产新生儿均可能引起毒性反应，发生“灰婴综合征” 。